患儿，女，3岁。生后发现口唇青紫，活动后加剧。平时喜蹲踞，哭吵时有突发呼吸急促、青紫加重，严重时伴晕厥，曾半年内晕厥2次，均于清晨或哭吵后发作，经2～3分钟自行恢复。今晨又出现晕厥，持续5分钟，即来急诊。查体：T37.0℃，P100次/分，R22次/分，BP82/55mmHg。神志不清，双肺听诊未见异常，胸骨左缘第2～4肋间闻及3/6级收缩期杂音，无震颤，肺动脉第二心音减弱。口唇青紫，指、趾甲青紫，杵状指、趾，颈软，神经系统查体无异常。最可能的诊断为
A. 单纯肺动脉瓣狭窄
B. 房间隔缺损伴轻度肺动脉瓣狭窄
C. 完全性大动脉转位
D. 室间隔缺损伴重度肺动脉高压
E. 法洛四联症

正确答案：E。法洛四联症

解析：女性患儿，有青紫、杵状指、趾、蹲踞及阵发性缺氧发作的表现。神志不清，双肺听诊未见异常，胸骨左缘第2～4肋间闻及3/6级收缩期杂音（肺动脉狭窄表现），无震颤，肺动脉第二心音减弱。综合患者的症状、体征和辅助检查，最可能的诊断为法洛四联症（E对）。单纯肺动脉瓣狭窄（A错）有蹲踞者很少见。房间隔缺损伴轻度肺动脉瓣狭窄（B错）肺动脉第二心音增强。完全性大动脉转位（C错）多无蹲踞表现。室间隔缺损伴重度肺动脉高压（D错）胸骨左缘第3、4肋可闻及响亮而粗糙的全收缩期杂音，伴有震颤。